以下哪种情况适宜做全瓷覆盖
A. 深覆（牙合）、覆盖小
B. 覆（牙合）、覆盖正常
C. （牙合）力较大的前牙
D. 固定桥的固位体
E. 以上都不对

正确答案：B。覆（牙合）、覆盖正常

解析：原则上所有需要金瓷烤瓷冠修复的患者，只要在经济条件允许情况下，都可考虑全瓷冠修复。深覆（牙合）、咬合紧，没有矫正而且又无法预备处足够间隙的患牙，为其禁忌症。深覆（牙合），覆盖小、（牙合）力较大的前牙、固定桥的固位体，三项均需要对牙齿切磨较多牙体组织才能达到全瓷覆盖效果，操作难度大，并且不利于牙周组织健康，所以。覆（牙合）、覆盖正常时才可使用全瓷覆盖。掌握“牙体缺损修复体固位及适应、禁忌证”知识点。